男，14岁。发热5天，伴乏力、纳差、恶心、尿黄1天。有不洁饮食史。査体：T38℃，巩膜黄染，肝肋下1.5cm，触叩痛（+），脾肋下未触及。实验室检查：血WBC8.5×10⁹/L，N0.54，L0.46，ALT1850U/L，TBil96umol/L，DBil63umol/L。首先考虑的诊断是
A. 急性病毒性肝炎
B. 沙门菌感染
C. 急性胆囊炎
D. 肾综合征出血热
E. 伤寒

正确答案：A。急性病毒性肝炎

解析：14男性，发热，伴乏力、纳差、恶心、尿黄，查体：T38℃，巩膜黄染，肝肋下1.5cm，触叩痛（+）（急性病毒性肝炎黄疸前期症状），实验室检查：WBC8.5×10⁹/L（成人正常参考值4～10×10⁹/L），中性粒细胞比例54%（成人正常参考值0.5～0.7），淋巴细胞比例46%（正常值0.2～0.4），ALT1850U/L（正常参考值0～40U/L），TBil96umol/L（正常参考值3.4～17.1μmol/L），DBil63ul/L（正常参考值0～6.8μmol/L），根据患者的临床表现和体征、个人史及实验室检查，首先考虑的诊断是急性病毒性肝炎（A对）。急性胆囊炎（C错）是由于胆囊管阻塞和细菌侵袭而引起的胆囊炎症；其典型临床特征为右上腹阵发性绞痛，伴有明显的触痛和腹肌强直（八版外科学P459）。肾综合征出血热（D错）是由流行性出血热病毒（汉坦病毒）引起的，以鼠类为主要传染源的自然疫源性疾病。以发热、出血、充血、低血压休克及肾脏损害为主要临床表现（P77）。伤寒（E错）一般会出现特殊中毒面容，相对缓脉，皮肤玫瑰疹，肝脾肿大，周围血象白细胞总数低下，嗜酸性粒细胞消失，骨髓象中有伤寒细胞（戒指细胞）（P149）。